某心理咨询师的母亲出现了心理问题，其妹妹想让其进行心理治疗，但他却把母亲转给其他心理咨询师治疗。该心理咨询师遵循的原则是
A. 保密原则
B. 真诚原则
C. 中立原则
D. 回避原则
E. 系统原则

正确答案：D。回避原则

解析：旧版心理学中，心理治疗的原则有真诚原则、保密原则、计划原则、中立原则、回避原则。回避原则（D对）是指由于心理治疗交谈十分深入，难免涉及隐私，因此心理治疗不宜在熟人之间进行，亲人与熟人均应在治疗中回避。该题中心理咨询师将母亲转给其他咨询师，而不选择自己对母亲进行治疗，遵循的就是回避原则。保密原则（A错）是指心理治疗往往涉及病人的各种隐私。为保证材料的真实，保证病人得到正确及时的指导，同时也为了维护心理治疗本身的声誉及权威性，必须在心理治疗工作中坚持保密原则。医生不得将病人的具体材料公布于众，即使在学术交流中不得不详细介绍病人的材料时，也应隐去其真实姓名。真诚原则（B错）是心理治疗的一个重要条件。医生对患者要真诚。在此基础上，患者才能不断接受医生提供的各种信息，逐步建立治疗动机，并能无保留地吐露个人心理问题的细节，为医生的准确诊断及设计、修正治疗方案提供可靠的依据，同时医生向患者提出的各种治疗要求也能得到遵守和认真执行。中立原则（C错）要求治疗者在心理治疗过程中保持中立的态度和立场。系统原则（E错）不是心理治疗的原则。